患者，男，48岁。腰痛，起病缓慢，隐隐作痛，绵绵不已，腰腿酸软乏力，腰冷，脉细。治疗除取主穴外，还应加
A. 风府、大杼、阳陵泉
B. 命门、志室、太溪
C. 人中、风府、足三里
D. 风府、三阴交、太冲
E. 风府、足三里

正确答案：B。命门、志室、太溪

解析：本题考查常见的病症的辩证、处方。题中患者腰痛，起病缓慢，隐隐作痛，绵绵不已，腰腿疫软乏力，腰冷，脉细，可辩证为肾虚腰痛。命门、志室、太溪合用可用于治疗肾虚腰痛（B对）。风府、大杼、阳陵泉合用可用于治疗神经根型颈椎病（A错）。风府、三阴交、太冲合用可用于固肾柔肝，调达气血（D错）。人中、风府、足三里等合用可祛除脾胃湿气，恢复精力，治疗虚劳（CE错）。